适合选用单端固定桥修复设计的是
A. 一侧基牙倾斜度大，松动
B. 两端基牙条件良好
C. 缺隙小，承受（牙合）力小，基牙条件好
D. 固位力主要来源于酸蚀与粘结技术
E. 缺隙两端基牙所承受的应力不均匀

正确答案：C。缺隙小，承受（牙合）力小，基牙条件好

解析：本题考查单端固定桥。适合选用单端固定桥修复设计的是缺隙小，承受（牙合）力小，基牙条件好（C对）。单端固定桥可用于缺隙小，承受（牙合）力小，基牙条件好的情况。半固定桥修复的特征是一侧基牙倾斜度大，无法获得共同就位道，但松动牙齿不宜作为基牙（A错）。双端固定桥修复的特点是两端基牙条件良好，可承受咬合压力（B错）。粘接桥的固位力主要来源于酸蚀与粘接技术（D错）。半固定桥两端基牙所承受的应力不均匀（E错），当桥体正中受到垂直向（牙合）力时，固定连接端的基牙所受的力大于活动连接端基牙。因为（牙合）力通过活动连接体的传导，使应力得以分散和缓冲，而固定连接端基牙则承担较大（牙合）力，容易使固定连接端基牙受到创伤。